一患者，检查：右上6颊侧牙龈卵圆形肿胀，波动感（+），袋深8mm.若此患者诊断为急性牙周脓肿，以下为首诊应选择的治疗措施，哪一项不正确
A. 深刮除净龈下牙石
B. 切开引流
C. 局部牙周袋内用药
D. 调磨明显早接触点
E. 全身抗生素+支持疗法

正确答案：A。深刮除净龈下牙石

解析：本题考查急性牙周脓肿的治疗原则。该患者诊断为急性牙周脓肿，且波动感（+），属于切开引流指征，应切开引流（B对）；局部牙周袋内用药（C对）有消炎抗菌止痛的作用，利于恢复；由于脓肿形成，牙周膜水肿，患牙会有浮起感，叩痛，松动明显，明显早接触点会引起患者疼痛，加重牙周组织破坏，应进行调磨（D对）；全身抗生素+支持疗法（E对）利于消炎，提高患者抵抗力，利于恢复健康；可轻轻清除大块牙石并冲洗牙周袋，此时不能深刮除净龈下牙石（A错，为本题的正确答案），会损伤脆弱到底牙周组织，加重病情，待到脓肿消退，急性炎症缓解方可将牙石彻底去净。